增加牙槽嵴相对高度的方法是
A. 唇舌系带矫正术
B. 牙槽嵴修整术
C. 骨性隆突修整术
D. 前庭沟加深术
E. 牙槽嵴重建术

正确答案：D。前庭沟加深术

解析：本题考查修复前的外科处理-唇、颊沟加深。若唇颊沟过浅，影响义齿基托边缘伸展，义齿常因唇颊肌活动而造成脱位，可做唇颊沟加深术（D对），相对地加高牙槽嵴，以增加义齿固位。当牙槽嵴吸收后呈低平者，系带附着点接近牙槽嵴顶，空气易进入基托与组织间，破坏了边缘封闭性而使义齿脱位，可做唇舌系带矫正术（A错）以恢复边缘密合。在牙槽嵴上有尖锐的骨尖、骨突和骨嵴或较大倒凹，可采用牙槽嵴修整术（B错）或骨性隆突修整术（C错）。牙槽嵴重建术（E错）是直接重建牙槽骨形态以达到理想修复效果的方法。